负责药品价格监督管理工作的部门是
A. 工商行政管理部门
B. 发展和改革宏观调控部门
C. 工业和信息化管理部门
D. 商务主管部门
E. 药品监督管理部门

正确答案：B。发展和改革宏观调控部门

解析：本题考查部门职责。国家发展和改革委员会（B对）负责监测和管理药品宏观经济，负责药品价格的监督管理工作，依法制定和调整药品政府定价目录，拟定和调整纳入政府定价目录的药品价格。